重大疾病医疗保险范围涵盖
A. 城镇居民医疗保险与城乡居民新农合
B. 城镇居民医疗保险与城镇职工医保
C. 所有大病居民
D. 城镇职工医疗保险与城乡新农合
E. 所有参保公民

正确答案：A。城镇居民医疗保险与城乡居民新农合

解析：重大疾病医疗保险的范围涵盖城镇居民医疗保险与城乡居民新农合（A对）。